接受头面部触觉信息的是
A. 薄束核和楔束核
B. 三叉神经脑桥核
C. 三叉神经脊束核
D. 内侧膝状体
E. 外侧膝状体

正确答案：B。三叉神经脑桥核

解析：三叉神经脑桥核（B对）主要接受头面部、口鼻腔的触压觉信息。三叉神经脊束核（C错）主要接受头面部的痛温觉信息。薄束核和楔束核（A错）接受躯干四肢意识性本体感觉和精细触觉信息。内侧膝状体（D错）是听觉传导通路第4级神经元胞体所在位置，接受听觉信息。外侧膝状体（E错）是视觉传导通路第3级神经元胞体所在位置，接受视觉信息。